不宜冷冻贮存的药品
A. 卡前列甲酯栓
B. 双歧三联活菌制剂
C. 胰岛素
D. 前列地尔注射液
E. 脂肪乳注射液

正确答案：B、C、D、E。双歧三联活菌制剂；胰岛素；前列地尔注射液；脂肪乳注射液

解析：本题考查药品的贮存。双歧三联活菌制剂（B对）、胰岛素（C对）、前列地尔注射液（凯时）（D对）、脂肪乳注射液（E对）冷冻会变质，不宜冷冻贮存。卡前列甲酯栓（A错）需低温（低于-5℃）保存。